胶剂制备时，应用冰糖的目的是
A. 增加胶剂的硬度
B. 降低胶剂的黏度
C. 沉淀溶液中的泥沙
D. 收胶时利于气泡的逸散
E. 收胶时起消泡作用

正确答案：A。增加胶剂的硬度

解析：本题考查的是胶剂辅料的种类与作用。胶剂制备时，应用冰糖的目的是增加胶剂的硬度（A对）。胶剂辅料的种类与作用：①冰糖：色白、洁净无杂质者为佳。冰糖可增加胶剂的透明度和硬度，并有矫味作用。也可用白糖代替。②油类：可用花生油、豆油、麻油，纯净无杂质的新制油为佳，酸败者禁用。油可降低胶块的黏度（B错），便于切胶，且在浓缩收胶时，油可促进锅内气泡的逸散，起消泡的作用（E错）。③酒类：多用绍兴黄酒，也可用白酒代替。酒起矫味矫臭作用，收胶时有利于气泡逸散（D错）。④明矾：色白洁净者为佳。可沉淀胶液中的泥沙杂质（C错），增加胶剂的透明度。